下列关于慢性肉芽肿性炎描述中错误的是
A. 指肉芽组织增生形成的结节状病灶
B. 病灶呈结节状，境界清楚
C. 结核病为肉芽肿性炎
D. 肉芽肿性炎是一种特殊性增生性炎
E. 梅毒为肉芽肿性炎

正确答案：A。指肉芽组织增生形成的结节状病灶

解析：慢性肉芽肿性炎是以肉芽肿形成为特征的特殊类型慢性炎症（D对），肉芽肿是指以炎症局部巨噬细胞及其衍生细胞增生（A错，为本题正确答案）形成的结节状病灶，境界清楚（B对）。结核病（C对）和梅毒（E对）均为肉芽肿性炎。